乙型强心苷的紫外最大吸收是
A. 217～220nm（lgξ4.20～4.24）
B. 295～300nm（lgξ3.93）
C. 345～350nm（lgξ2.80）
D. 350～360nm（lgξ4.00）
E. 370～400nm（lgξ3.00）

正确答案：B。295～300nm（lgξ3.93）

解析：本题考查的是乙型强心苷的最大吸收峰。乙型强心苷的紫外最大吸收是295～300nm（lgξ3.93）（B对）。具有Δαβ-γ-内酯环的甲型强心苷元在217～220nm（lgξ4.20～4.24）（A错）处呈现最大吸收，具有Δαβ、Δγδ-δ-内酯环的乙型强心苷元在295～300nm（lgξ3.93）处有特征吸收。借此可区分两类强心苷。